宜采用明煅法炮制的中药有
A. 牡蛎
B. 石决明
C. 白矾
D. 石膏
E. 赭石

正确答案：A、B、C、D。牡蛎；石决明；白矾；石膏

解析：本题考查的是明煅法。宜采用明煅法炮制的中药有牡蛎（A对）、石决明（B对）、白矾（C对）与石膏（D对）。明煅：指药物煅制时，不隔绝空气的方法，又称直火煅法。该法主要适用于矿物类、贝壳类及化石类药物。明煅的主要目的：①使药物质地酥脆，如花蕊石等。②除去结晶水，如白矾、硼砂等。③使药物有效成分易于煎出，如钟乳石、花蕊石等。采用明煅法炮制的中药有白矾、牡蛎、石决明、石膏等。赭石（E错）宜采用煅淬炮制。煅淬：将药物在高温有氧条件下煅烧至红透后，立即投入规定的液体辅料中骤然冷却的方法称为煅淬。煅淬法适用于质地坚硬，经过高温仍不能疏松的矿物药以及临床上因特殊需要而必须煅碎的药物。煅淬的主要目的：①使药物质地酥脆，易于粉粹，利于有效成分煎出，如赭石、磁石。②改变药物的理化性质，减少副作用，增强疗效，如自然铜。③清除药物中夹杂的杂质，洁净药物，如炉甘石。采用煅淬法炮制的中药有赭石、自然铜、炉甘石等。